下列属于营养必需脂肪酸的是
A. 亚麻酸
B. 软脂酸
C. 十二碳脂肪酸
D. 油酸
E. 硬脂酸

正确答案：A。亚麻酸

解析：本题考查营养必需脂肪酸。营养必需脂肪酸包括亚油酸、α-亚麻酸（A对BCDE错）及花生四烯酸。